引起卡波西肉瘤的病毒是
A. HPV
B. HSV
C. HIV
D. 柯萨奇A16病毒
E. 人类疱疹病毒8型

正确答案：E。人类疱疹病毒8型

解析：本题考查常见性传播疾病及其病原体。引起卡波西肉瘤的病毒是人类疱疹病毒8型（E对ABCD错），又称卡波希氏肉瘤相关疱疹病毒。